先天性巨结肠首选检查
A. X线检查
B. CT检查
C. 结肠镜检查
D. 腹部B超
E. 胃镜检查

正确答案：A。X线检查

解析：先天性巨结肠的X线检查可见在病变肠段以上肠管扩张，内含有气体和液性粪便-气液平面，而在病变肠段中不含气体，呈现一个典型的低位肠梗阻征象，故将X线检查作为首选检查方法(A对)。CT检查用于结肠癌判断分期（B错）。结肠镜检查可用于诊断大肠疾病和结肠镜下操作（C错）。超声是诊断胆道疾病的首选方法（D错）。胃镜主要用于检查上消化道疾病（E错）。